下列不是Poisson分布的是
A. 单位时间内某急救中心收到的呼救次数
B. 某山区成年男子平均脉搏数
C. 某放射性物质发射出的粒子数
D. 单位空间中粉尘颗粒数
E. 野外单位空间中某种昆虫数

正确答案：B。某山区成年男子平均脉搏数